关于中耳鼓室壁的描述中，错误的为
A. 上壁为鼓室盖，分隔鼓室与颅中窝
B. 后壁为乳突壁
C. 内侧壁也叫迷路壁
D. 外侧壁为鼓膜
E. 咽鼓管咽口位于鼻咽部的侧壁,鼓室口开口于鼓室的前壁

正确答案：E。咽鼓管咽口位于鼻咽部的侧壁,鼓室口开口于鼓室的前壁

解析：鼓室有6个壁，分别为上壁，又称盖壁，分隔鼓室与颅中窝（A错）。外侧壁大部分由鼓膜构成，故又名鼓膜壁（D错）。内侧壁又称迷路壁（C错），与内耳相隔。后壁为乳突壁（B错）。咽鼓管咽口位于鼻咽部的侧壁，咽鼓管鼓室口开口于鼓室前壁（E对）。